男，74岁，争吵中起病，血压80/60mmHg，双肺湿啰音，咳泡沫痰，无双下肢水肿，患者最可能的诊断是
A. 急性左心衰
B. 急性右心衰
C. 全心衰
D. 慢性心衰
E. 支气管扩张

正确答案：A。急性左心衰

解析：患者74岁，争吵中起病，血压80/60mmHg（血压降低），双肺湿啰音，咳泡沫痰（符合急性左心衰的临床表现），无双下肢水肿（说明暂无右心衰体征），结合以上表现和体征，最可能的诊断为急性左心衰（A对）。急性右心衰（B错）一般表现为下肢对称性水肿、肝颈静脉回流征阳性、心界向左下扩大。全心衰（C错）会出现呼吸困难症状好转、心界向两侧扩大的表现。慢性心衰（D错）可分为慢性左心衰、慢性右心衰、全心衰。支气管扩张（E错）一般表现为反复咳嗽咳痰、咳血、杵状指。